影响因素试验包括
A. 高温试验、高湿度试验、强光照射试验
B. 高温试验、高压试验、高湿度试验
C. 高湿度试验、高酸度试验、强光照射试验
D. 高温试验、高湿试验、高压试验
E. 高温试验、高压试验、强光照射试验

正确答案：A。高温试验、高湿度试验、强光照射试验

解析：本题考查药物稳定性试验方法。影响因素试验包括高温试验、高湿度试验、强光照射试验（A对）。影响因素试验包括高温试验、高湿度试验、强光照射试验。
药物制剂进行此项试验的目的是考察制剂处方的合理性与生产工艺及包装条件。